反应药物在体内的吸收速度的药动学参数是
A. 半衰期（t1/2）
B. 表观分布容积（V）
C. 药物浓度-时间曲线下面积（AUC）
D. 清除率（Cl）
E. 达峰时间（tmax）

正确答案：E。达峰时间（tmax）

解析：本题考查药动学参数。反应药物在体内的吸收速度的药动学参数是达峰时间（tmax）（E对）；生物半衰期（A错）通常表示药物从体内消除的快慢；表观分布容积（V）（B错）反映了药物在体内的分布情况；药物浓度-时间曲线下面积（AUC）（C错）反映药物吸收程度；清除率（Cl）（D错）体现药物消除的快慢。